某女大学生，19岁，病前有强迫性人格特征，在一次动物实验中，因抓大白鼠的方法不对而被鼠咬，引起焦虑和恐惧发作。而后表现为见鼠就惊叫、害怕、心跳剧烈，发展到有人谈到鼠也出现焦虑、紧张、出汗症状。病人主动求医，要求治疗。心理治疗方法应首选
A. 自由联想疗法
B. 厌恶疗法
C. 奖励方法
D. 系统脱敏疗法
E. 生物反馈疗法

正确答案：D。系统脱敏疗法